下列各项，不属内伤咳嗽的是
A. 痰热咳嗽
B. 痰湿咳嗽
C. 气虚咳嗽
D. 阴虚咳嗽
E. 风热咳嗽

正确答案：E。风热咳嗽

解析：咳嗽是小儿常见的一种肺系病症，有声无痰为咳，有痰无声为嗽，有声有痰谓之咳嗽，分为外感咳嗽和内伤咳嗽，外感咳嗽主要是感受外邪，其中又以风邪为主，主要包括风寒咳嗽和风热咳嗽；内伤咳嗽主要由于肺脾虚弱所致，包括痰热咳嗽（A对）、痰湿咳嗽（B对）、气虚咳嗽（C对）和阴虚咳嗽（D对），故风热咳嗽（E错，为本题正确答案）属于外感咳嗽，不属于内伤咳嗽。